属子宫内膜脱落不全的病证是
A. 崩漏
B. 月经过多
C. 经期延长
D. 月经先期
E. 月经后期

正确答案：C。经期延长

解析：子宫内膜不规则脱落由于下丘脑-垂体-卵巢轴调节功能紊乱，或溶黄体机制失常，引起黄体萎缩不全，而内膜持续受孕激素影响，不能如期完整脱落。正常月经第3～4日时，分泌期子宫内膜已全部脱落。黄体萎缩不全时，月经期第5～6日仍能见到呈分泌反应的子宫内膜，常表现为残留的分泌期内膜与出血坏死组织及新增生的内膜混合共存。所以表现为月经间隔时间正常，但经期延长9-10天，量多（C对）；崩漏是指妇女不在行经期，阴道大量出血，或持续下血淋漓不断，又称"崩中漏下"（A错）；月经过多是连续数个周期月经期出血量多，失血量多于80毫升，但月经间隔时间及出血时间皆规则的一种临床症状，由于神经内分泌功能失调、卵巢功能异常、器质性病变或药物等因素导致（B错）；月经先期是指月经周期提前7天以上，甚至10余天一行，连续3个周期以上（D错）；月经后期是指月经周期延后7天以上，甚至3到5个月，连续两个周期以上（E错）。